肱骨骨折最容易发生的部位为
A. 肱骨头
B. 外科颈
C. 上1/3
D. 中1/3
E. 中外1/3

正确答案：B。外科颈

解析：肱骨外科颈为肱骨大结节、小结节移行为肱骨干的交界部位，该部位是松质骨和密质骨的交接处，易发生骨折（B对）。